男性，51岁。慢性阻塞性肺疾病史6年，1小时前突发呼吸困难加重，右侧胸痛、大汗、发绀，首先考虑诊断
A. 急性胸膜炎
B. 急性心肌梗死
C. 自发性气胸
D. 细菌性肺炎
E. 急性肺栓塞

正确答案：C。自发性气胸

解析：患者为中老年男性，患有慢性阻塞性肺疾病史6年，其并发症多有慢性呼吸衰竭、自发性气胸以及慢性肺源性心脏病。1小时前突发呼吸困难加重，右侧胸痛大汗发绀等表现符合自发性气胸的表现，故首先考虑诊断自发性气胸（C对）。急性胸膜炎（A错）最常见的症状为胸痛，常突然发生，可为不明确的不适或严重的刺痛，由于深呼吸可致疼痛，故患者可有呼吸浅快，此类患者多有肺梗死、结核病、癌症、系统性红斑狼疮等疾病，故该患者不考虑此病。急性心肌梗死（P236）（B错）的患者多有静息痛或夜间心绞痛，胸痛程度较重，持续时间较长，可有出汗、恶心、心悸或呼吸困难等，故该患者不考虑此病。细菌性肺炎（P46）（D错）大多起病急骤、高热、寒战，也可有患侧胸部疼痛，患者常呈急性病容，但是一般不会出现呼吸困难加重以及发绀等，故该患者不考虑此病。急性肺栓塞（P100）（E错）是指来自静脉系统或右心的血栓栓塞肺动脉或其分支所导致的以肺循环和呼吸功能障碍为主要临床症状的疾病，主要表现有不明原因的呼吸困难及气促、胸痛、晕厥、烦躁不安甚至濒死感、咯血，此类患者多有长时间卧床史或下肢手术史等，故该患者不考虑此病。